外表面灰黑色至黑色，凹凸不平；切面类白色或黄白色，略呈颗粒状的饮片是
A. 小叶海棠
B. 茯苓皮
C. 茯苓片
D. 灵芝片
E. 猪苓片

正确答案：E。猪苓片

解析：本题考查的是猪苓饮片的性状鉴别。外表面灰黑色至黑色，凹凸不平；切面类白色或黄白色，略呈颗粒状的饮片是猪苓片（E对）。猪苓：【性状鉴别】饮片为类圆形或不规则形的厚片。外表皮黑色、灰黑色或棕黑色，皱缩。切面类白色或黄白色，略呈颗粒状。气微，味淡。茯苓皮（B错）：【性状鉴别】呈长条形或不规则块片，大小不一。外表面棕褐色至黑褐色，有疣状突起；内面淡棕色并常伴有白色或淡红色的皮下部分。质较松软，略具弹性。气微，味淡，嚼之粘牙。茯苓片（C错）：【性状鉴别】为去皮后切制的茯苓，呈不规则厚片，厚薄不一。白色、淡红色或淡棕色。小叶海棠（A错）与灵芝片（D错）的性状鉴别，2022年考试指南未明确说明。